正常腮腺组织中的大导管上皮细胞间可见因腺体慢性炎症而增多的哪种细胞
A. 典型的皮脂腺细胞
B. 含脂肪的导管上皮细胞
C. 晶样体
D. 含黏液的杯状细胞
E. 脂肪细胞

正确答案：D。含黏液的杯状细胞

解析：腮腺大导管上皮细胞间可见少数含有黏液的杯状细胞，此细胞因腺体慢性炎症而增多。掌握“唾液腺组织学特点”知识点。